原发性高血压特点不包括
A. 血压随季节变化而变化
B. 血压随昼夜变化而变化
C. 冬季血压较高
D. 一般夜间血压较高
E. 清晨起床前未活动时血压最低

正确答案：D。一般夜间血压较高

解析：原发性高血压体征：血压随季节、昼夜、情绪等因素有较大波动。冬季血压较高，夏季较低；血压有明显昼夜波动，一般夜间血压较低，清晨起床未活动时血压最低，活动后血压迅速升高，形成清晨血压高峰。患者在家中的自测血压值往往低于诊所血压值。掌握“原发性高血压”知识点。